对放射治疗最敏感的卵巢恶性肿瘤是
A. 无性细胞瘤
B. 内胚窦瘤
C. 间质细胞瘤
D. 畸胎瘤
E. 两性母细胞瘤

正确答案：A。无性细胞瘤

解析：对放射治疗最敏感的卵巢恶性肿瘤是无性细胞瘤（A对）。无性细胞瘤为中度恶性的实性肿瘤，属于卵巢生殖细胞肿瘤。对放疗敏感，但放疗会破坏患者卵巢功能，常造成患者生育功能的丧失，现已极少应用，仅用于治疗复发的无性细胞瘤。畸胎瘤（P329）（D错）属于卵巢生殖细胞肿瘤，对放疗效果一般，通常采用手术及联合化疗。内胚窦瘤（P329）（B错）又称卵黄囊瘤，属于卵巢生殖细胞肿瘤。恶性程度高，预后差，但对化疗十分敏感，现经手术及联合化疗，生存期明显延长。间质细胞瘤（P330）（C错）的特点是此类肿瘤常有内分泌功能，属于卵巢性索间质肿瘤；两性母细胞瘤（八年制第2版妇产科学P351）（E错）是指包含颗粒细胞瘤、卵泡膜细胞瘤、支持细胞瘤和间质细胞瘤四种成分的卵巢性索间质肿瘤，两者通常采用手术治疗。